（133～134题共用题干）男，25岁。腰背部疼痛8年，晨起明显，活动后减轻。近1个月腰痛加重，活动受限。查体：腰椎前屈、后伸受限，Schober试验（+），双侧“4”字试验（+）。对确诊最有价值的检查是
A. 血沉
B. 骶髂关节X线片
C. 血常规
D. HLA-B27
E. 类风湿因子

正确答案：B。骶髂关节X线片

解析：患者男，25岁（为强直性关节炎的好发人群），有腰背部疼痛8年病史，晨起明显，活动后减轻，活动受限（为强直性脊柱炎的特征性临床表现）。查体：腰椎前屈、后伸受限，Schober试验（+），双侧“4”字试验（+）。结合该患者病史、临床表现、体查，该患者诊断考虑为强直性关节炎。根据纽约标准（1984年），现只需确诊病人双侧骶髂关节炎Ⅱ～Ⅳ级，或单侧骶髂关节炎Ⅲ～Ⅳ级，即可诊断为强直性脊柱炎。髂关节X线片（B对）可以显示各个时期的骨质改变，为明确诊断最有价值的检查。